氟牙症最理想的预防方法是
A. 家长监督刷牙方法
B. 含氟量适宜的水源
C. 每天至少刷两次牙
D. 从小使用含氟牙膏
E. 幼儿园使用含氟凝胶

正确答案：B。含氟量适宜的水源

解析：本题考查氟牙症的防治原则。氟牙症最理想的预防方法是含氟量适宜的水源（B对）。1.预防氟牙症的基本原则是在牙发育矿化期限制摄入过量的氟，最理想的预防方法是选择含氟量适宜的水源，或分别应用活性矾土（Al₂Q₃）或活性炭去除水源中过量的氟，但后者费用昂贵，难以推广。特别是在高氟地区，对于特殊人群如孕妇及8岁以前的儿童，一方面使用含氟量适宜的水源，另一方面要营养全面，适当补充维生素A、维生素D和适量的钙、磷，可减轻氟对机体的损害。2.对于无实质性缺损的氟牙症，前牙可采用脱色法，后牙可不予处理;；对于有实质性缺损的氟牙症，可采用复合树脂粘接修复，重者也可采用贴面、全冠修复等方法处理。